男，51岁，近3年来出现关节炎症状和尿路结石，进食肉类食物时，病情加重。该患者发生的疾病涉及的代谢途径是
A. 糖代谢
B. 脂代谢
C. 嘌呤核苷酸代谢
D. 嘧啶核苷酸代谢
E. 氨基酸代谢

正确答案：C。嘌呤核苷酸代谢

解析：患者中年男性，出现关节炎症状和尿路结石，进食高嘌呤饮食（肉类食物）后病情加重，考虑为痛风症。痛风症是指患者血中尿酸含量升高，当超过8mg/100ml时，尿酸盐晶体即可沉积于关节、软组织、软骨及肾等处，而导致关节炎、尿路结石及肾疾病。痛风症多见于成年男性，其原因尚不完全清楚，可能与嘌呤核苷酸代谢（C对）酶的缺有关。